治疗肺热咳嗽，肺痈肠痈，应选用的药物是
A. 竹茹
B. 白果
C. 半夏
D. 瓜蒌
E. 紫菀

正确答案：D。瓜蒌

解析：治疗肺热咳嗽，肺痈肠痈，当性味苦、寒，且入肺、大肠经。瓜蒌性甘寒清润，善于清肺热、润肺燥而化热痰、燥痰，治疗肺热咳嗽，痰浊黄稠；此外瓜蒌能清热散结消肿，常配清热解毒药以治肺痈、肠痈（D对）；竹茹虽性苦、寒，且能清肺化痰，治疗肺热咳嗽，但竹茹不入大肠经，不能治疗肺痈（A错）；白果能敛肺定喘，治疗喘咳痰多；能止带缩尿，治疗带下白浊，遗尿尿频，且性平，不能清肺、大肠之热（B错）；半夏虽能燥湿化痰，降逆止呕，但半夏性味辛温，适用于寒痰咳嗽，且半夏不入大肠经（C错）；紫菀能润肺下气，化痰止咳，能治疗疲多喘咳，新久咳嗽，劳嗽咳血，无论寒热均可，紫菀但入大肠经，不能治疗肠痈（E错）。